灾区饮用水卫生标准规定，用氯消毒时
A. 井水中游离性余氯不低于2mg/L
B. 井水中游离性余氯不低于0.3mg/L
C. 井水中化合性余氯不低于0.5mg/L
D. 井水中游离性余氯维持在2mg/L
E. 井水中游离性余氯维持在0.5mg/L

正确答案：E。井水中游离性余氯维持在0.5mg/L